前置胎盘病例，适用于阴道分娩的是
A. 部分性前置胎盘而胎儿为头位
B. 边缘性前置胎盘而胎儿为头位
C. 部分性前置胎盘而胎儿为臀位
D. 低置胎盘而胎儿为臀位
E. 以上都不是

正确答案：B。边缘性前置胎盘而胎儿为头位

解析：前置胎盘阴道分娩适用于边缘性前置胎盘、出血不多、头先露、无头盆不称及胎位正常，且宫颈口已开大、估计短时间内分娩者。掌握“前置胎盘”知识点。